在中国药典中，苯巴比妥的含量测定方法是
A. 重量法
B. 铈量法
C. 银量法
D. 亚硝酸钠滴定法
E. 非水溶液滴定法

正确答案：C。银量法

解析：本题考查苯巴比妥的含量测定方法。在中国药典中，苯巴比妥的含量测定方法是银量法（C对）。